患者，女，28岁，体重80kg。12年前于颅脑外伤后出现癫痫全面强直-阵挛性发作，间断有失神发作，最初服用丙戊酸钠缓释片，后因效果不佳，陆续加用奥卡西平片、拉莫三嗪片，三药合用至今已3年；另外间断服用碳酸钙片、骨化三醇胶丸。关于抗癫痫药使用注意事项和患者教育的说法，错误的是
A. 应长期规律用药
B. 停药时应逐渐减量
C. 停药后复发率20%～40%
D. 若持续1年以上无癫痫发作，可停药
E. 复发多在停药后2年内发生

正确答案：D。若持续1年以上无癫痫发作，可停药

解析：本题考查抗癫痫药使用注意事项和患者教育。如果持续2年以上没有癫痫发作，可与医生讨论停药事宜（D错，为本题正确答案）。服用抗癫痫药应小剂量起始，滴定增量，长期规律用药（A对）。停用抗癫痫药时应逐渐减量（B对），停药的过程为半年至1年甚至更长。停药后复发率为20%～40%（C对），多出现在停药后2年以内（E对）。